以下哪种途径不是人体对进入呼吸道的粉尘的排出途径
A. 黏液纤毛装置的纤毛摆动
B. 肺泡巨噬细胞吞噬后沿呼吸道向上而排出
C. 尘细胞受损、坏死、崩解后排出
D. 通过吞噬细胞本身的阿米巴运动而排出
E. 尘粒进入淋巴或血循环系统后沉积于淋巴结或其他脏器

正确答案：C。尘细胞受损、坏死、崩解后排出

解析：本题考查人体对呼吸道粉尘的排出途径。人体对吸入的粉尘具备有效的防御和清除作用，一般有三道防线：（1）鼻腔、喉、气管支气管树的阻留作用；（2）呼吸道上皮黏液纤毛系统的排出（A对）作用；（3）肺泡巨噬细胞的吞噬（B对）作用，进入肺泡的粉尘黏附在肺泡腔表面，被肺泡巨噬细胞吞噬，形成尘细胞。大部分尘细胞通过自身阿米巴样运动（D对）及肺泡的舒张转移至纤毛上皮表面，再通过纤毛运动而清除。小部分尘细胞因粉尘作用受损、坏死、崩解（C错，为本题正确答案），尘粒游离后再被巨噬细胞吞噬，如此循环往复，这部分尘细胞的过程并不能有助于机体排出粉尘粒子。此外，尘细胞和尘粒可以进入淋巴系统，沉积于肺门和支气管淋巴结，经淋巴循环进入血液循环到达其他脏器（E对）。